男，68岁。反复咳嗽，咳痰20余年，气短5年。患者长期使用吸入糖皮质激素及支气管舒张剂治疗，近1周症状控制欠满意，联合使用某药物治疗。此后出现排尿困难。该患者近来增加的药物最可能的
A. 茶碱类
B. M受体拮抗剂
C. β₂受体激动剂
D. 口服糖皮质激素
E. 袪痰治疗

正确答案：B。M受体拮抗剂

解析：患者老年男性，反复咳嗽，咳痰20余年，气短5年（慢性支气管炎病史）。患者长期使用吸入糖皮质激素及支气管舒张剂治疗，诊断为慢阻肺，近1周症状控制欠满意，联合使用某药物治疗。此后出现排尿困难（为迷走神经所支配膀胱M受体抑制表现），该患者近来增加的药物最可能的M受体拮抗剂（B对）。茶碱类，β₂受体激动剂，袪痰治疗为慢阻肺稳定期治疗，不会对M受体起作用。（ACE错）慢阻肺多通过吸入糖皮质激素治疗（D错）。